女，35岁，体重50Kg，汽油火焰Ⅱ°烧伤面积73%，第一个24小时补液总量为
A. 5500ml
B. 6500ml
C. 7500ml
D. 8500ml
E. 9500ml

正确答案：C。7500ml

解析：患者女性35岁，体重50kg，烧伤面积为73％，根据烧伤补液原则（P142-P143），第一个24小时补液总量=体重×Ⅱ°、Ⅲ°烧伤面积×1.5+基础水分2000ml=50×73×1.5＋2000=7475ml，约为7500ml（C对）。